下列关于直肠的说法何者正确
A. 分为盆部和会阴部
B. 有凸向前的骶曲
C. 有凹向前的会阴曲
D. 在第1骶椎平面与乙状结肠相续
E. 最大的直肠横襞位于其前右侧壁

正确答案：E。最大的直肠横襞位于其前右侧壁

解析：直肠分为盆部和肛门部(A错)，有凸向后方的骶曲(B错)，凸向前方的会阴曲(C错)，在第3骶椎平面与乙状结肠相续(D错)，最大的直肠横襞位于其前右侧壁(E对)。